男，32岁。周期性空腹及夜间上腹痛4年，饱食后突发剧烈上腹痛3小时。查体：上腹部腹肌紧张，压痛阳性。肝浊音界消失。该患者最可能的诊断是
A. 胃溃疡合并出血
B. 十二指肠溃疡穿孔
C. 急性胰腺炎
D. 急性腹膜炎
E. 绞窄性肠梗阻

正确答案：B。十二指肠溃疡穿孔

解析：中年男性患者，周期性空腹及夜间上腹痛（十二指肠溃疡特征）4年，提示十二指肠溃疡。饱食后突发剧烈上腹痛，查体：上腹部腹肌紧张、压痛阳性（腹膜炎体征），肝浊音界消失（十二指肠溃疡穿孔后气体积聚在膈下），该患者考虑诊断为十二指肠溃疡穿孔（B对）。胃溃疡（A错）表现为餐后痛，1～2个小时后缓解。急性胰腺炎（C错）腹痛无节律性，可向背部放射，伴有腹胀、恶心、呕吐，无肝浊音界消失的表现。该患者因溃疡穿孔引起弥漫性腹膜炎，若单纯诊断为急性腹膜炎不够全面（D错）。绞窄性肠梗阻（E错）主要表现为持续性剧烈腹痛、呕吐、肛门停止排便排气，无肝浊音界消失表现。